粘接修复失败的原因不包括
A. 去除洞壁护髓材料
B. 粘接剂太厚
C. 牙面未彻底清洁
D. 未固化前移动了粘接修复体
E. 隔湿不严密

正确答案：A。去除洞壁护髓材料

解析：本题考查粘接修复失败的原因。护髓材料是溶于唾液的，洞壁上有护髓材料，会发生溶解，导致粘接失败，所以去除洞壁护髓材料（A错，为本题正确答案）有利于提高粘接效果。若粘接剂太厚（B对），由于强度不够，容易断裂，会导致粘接修复失败。牙面未彻底清洁（C对）、隔湿不严密（E对）都会导致粘接剂和修复体、充填体不密合，无法发挥粘接作用导致粘接修复失败。若未固化前移动了粘接修复体（D对），则粘接剂与修复体的粘接界面的结合作用会被终止，此时粘接剂已部分固化，粘接界面被破坏导致粘接修复失败。